提出著名的“治泻九法”的医家是
A. 张仲景
B. 陈无择
C. 张景岳
D. 李中梓
E. 叶天士

正确答案：D。李中梓

解析：李中梓在《医宗必读·泄泻》中提出了著名的治泻九法，即淡渗、升提、清凉、疏利、甘缓、酸收、燥脾、温肾、固涩，全面论述了泄泻的治法（D对）。张仲景在《金匮要略·呕吐哕下利病脉证治》中将泄泻与痢疾统称为下利（A错）。陈无择在《三因极一病证方论·泄泻叙论》中认为不仅外邪可导致泄泻，情志失调亦可导致泄泻（B错）。张景岳在《景岳全书·泄泻》：“凡泄泻之病，多由水谷不分，故以利水为上策”，提出分利之法治疗泄泻的原则（C错）。叶天士为清代医学家，对于泄泻病因强调湿邪致泻的主导性，病机重视肝、脾、肾（E错）。